男性，26岁，5天来鼻及牙龈出血，皮肤瘀斑，血红蛋白55g，白细胞10.0×10⁹/L，血小板16×10⁹/L。骨髓增生活跃，幼稚细胞占80%，胞浆有大小不等颗粒及成堆棒状小体，过氧化酶染色强阳性。诊断考虑
A. 急性早幼粒细胞性白血病
B. 急性淋巴细胞性白血病
C. 急性粒细胞白血病
D. 慢性粒细胞性白血病急变
E. 急性单核细胞性白血病

正确答案：A。急性早幼粒细胞性白血病

解析：患者青年男性，5天来鼻及牙龈出血，皮肤瘀斑（出血表现），血红蛋白55g（成年男性Hb正常值120～160g/L），提示贫血，白细胞10.0×10⁹/L（正常4～10×10⁹/L），血小板16×10⁹/L（正常100～300×10⁹/L）明显减少，骨髓增生活跃，幼稚细胞占80％（原始或幼稚细胞≥30%（FAB分型）或≥20%（WHO分型）即可诊断为急性白血病），胞浆有大小不等颗粒（早幼粒细胞的特点）及成堆棒状小体（见于急性非淋巴细胞白血病），过氧化酶染色强阳性（见于急性粒细胞白血病、急性早幼粒细胞白血病），故患者应诊断为急性早幼粒细胞白血病（A对）。急性淋巴细胞性白血病（B错）常有淋巴结肿大，细胞胞浆内无棒状小体，过氧化物染色阴性；急性粒细胞白血病（C错）虽然过氧化酶染色强阳性，但细胞胞浆内无颗粒；慢性粒细胞白血病急变（D错）病程长，脾肿大显著；急性单核细胞白血病（E错）虽可见棒状小体，但过氧化酶染色弱阳性或阴性，常出现牙龈增生，皮肤损害。